原发性肝癌中最常见的首发临床表现是
A. 肝脏肿大
B. 食欲减退
C. 恶心、呕吐
D. 肝区疼痛
E. 体重下降

正确答案：D。肝区疼痛

解析：肝癌早期常无典型症状，出现症状和体征后一般处于中晚期。常见症状包括肝区疼痛，全身和消化道症状如恶心呕吐等，查体可见肝大。其中，最常见的首发临床表现是肝区疼痛（D对）。